传统汤剂是将药物用煎煮或浸泡后去渣取汁的方法制成的液体剂型。关于汤剂煎煮程序的说法，错误的是
A. 为便于煎出有效成分在煎煮前先加常温水浸泡20～30分钟
B. 第一煎加水量一般高于药面2～5cm，第二煎加水量酌减
C. 每剂药煎好后待放凉再滤出煎液
D. 每剂药的总煎出量成人一般为400～600ml
E. 剩余残渣挤出的残液量不超过残渣总重量的20%

正确答案：C。每剂药煎好后待放凉再滤出煎液

解析：本题考查的是中药汤剂的煎药程序。每剂药煎好后，应趁热及时滤出煎液（C错，为本题正确答案）。中药汤剂的煎药程序：1.煎药人员收到待煎药时应核对处方药味、剂量、数量及质量，查看是否有需要特殊处理的饮片，如发现疑问及时与医师或调剂人员联系，确认无误后方可加水煎煮。2.为便于煎出有效成分，在煎煮前先加常温水浸泡饮片，浸泡时间一般不少于30分钟（A对），使药材充分吸收水分。但不宜使用60℃以上的热水浸泡饮片，以免使药材组织细胞内的蛋白质遇热凝固、淀粉糊化，不利于药效成分的溶出。加水量的多少受饮片的重量、质地等影响，一般用水量以高出药面2～5cm为宜，第二煎则应酌减（B对）。用于小儿内服的汤剂可适当减少用水量。注意在煎煮过程中不要随意加水或抛弃药液。3.群药按一般煎药法煎煮，需特殊煎煮的饮片则按特殊方法处理。在煎煮过程中要经常搅动，并随时观察煎液量，使饮片充分煎煮，避免出现煎干或煎煳现象。若已煎干则宜加新水重煎，若已煎煳则应另取饮片重新煎煮。4.煎煮用火应遵循“先武后文”的原则。即在沸前宜用武火，使水很快沸腾；沸后用文火，保持微沸状态，使之减少水分蒸发，以利于药效成分的煎出。解表药多用武火，补虚药多用文火。5.煎药时间的长短，常与加水量、火力、药物吸水能力及治疗作用有关。中药煎煮一般分为一煎、二煎。一般药一煎沸后煎20～30分钟，二煎沸后煎15～20分钟；解表、清热、芳香类药不宜久煎，一煎沸后煎15～20分钟，二煎沸后煎10～15分钟；而滋补药一煎沸后文火煎40～60分钟，二煎沸后煎30～40分钟为宜。6.每剂药煎好后，应趁热及时滤出煎液，以免因温度降低而影响煎液的滤出及有效成分的含量。滤药时应压榨药渣，使药液尽量滤净。将两次煎液合并混匀后分两次服用。7.每剂药的总煎出量为成人400～600ml（D对），儿童100～300ml。8.煎药质量要求为依法煎煮的药液应有原处方中各味中药的特征气味，无霉烂、酸腐等其他异味；剩余的残渣无硬心，无白心、无焦化或煳化，挤出的残液量不超出残渣总重量的20%（E对）。9.核对患者姓名、取药号、药味、质量及煎煮方法等，复核无误后，即可签字发出。